牵牛子不具有的功效是
A. 泻下
B. 去积
C. 逐水
D. 杀虫
E. 破血

正确答案：E。破血

解析：本题考查牵牛子的功效。牵牛子不具有的功效是破血（E错，为本题正确答案）。牵牛子【功效】泻下（A对），逐水（C对），去积（B对），杀虫（D对）。